GMP的基本内容和要求不包括
A. 人员
B. 厂房环境和设施
C. 质量管理
D. 卫生管理
E. ISO 9000体系认证

正确答案：E。ISO 9000体系认证

解析：本题考查GMP的基本内容和要求。GMP即食品良好生产规范，是为保障食品安全、质量而制定的贯穿食品生产全过程的一系列措施、方法和技术要求。其基本内容和要求有：1.人员（A对）：包括人员素质，教育与培训；2.企业的设计与设施：包括厂房环境及设施（B对），设备、工具；3.质量管理（C对）：包括机构，质量管理部门的任务，生产过程管理，原料、半成品和成品的品质管理；4.成品的储存与运输；5.标识；6.卫生管理（D对）；7.成品售后意见的处理。ISO 9000体系认证（E错，为本题正确答案）不属于GMP的基本内容和要求。